骨折治疗的基本原则是
A. 复位后固定，给予促进骨折愈合
B. 手法复位，外固定，给予活血化瘀药物
C. 切开复位，内固定，给予抗生素
D. 复位后固定，并开始功能锻炼
E. 复位后固定，待解除固定后开始功能锻炼

正确答案：D。复位后固定，并开始功能锻炼

解析：骨折治疗的原则为复位、固定和康复治疗（即功能锻炼）。功能锻炼在不影响固定的情况下，应尽早进行（D对），如果待解除固定后开始功能锻炼，易影响患肢功能的恢复或造成二次损伤（E错）。复位的方法应依据骨折的部位、类型和严重程度等选择手法复位或切开复位，复位后选择合适的内固定或外固定，同时合理应用抗生素，但不能使用活血化瘀药物（BC错）。复位固定后，可给予促骨折愈合的药物，但这不是骨折治疗的基本原则（A错）。